患者，女，35岁，癫痫病史10年。在工作时突然跌倒在地，口吐白沫、四肢强直、抽搐发作。下列其同事给予的处理措施中，正确的有
A. 在患者背后垫衣被等软物
B. 使患者头偏向一侧
C. 用力按住其手足，阻止抽搐发作
D. 解松患者的衣领、裤带等约束的衣物，以利呼吸
E. 注意心脏、呼吸情况，抽搐后呼吸未能及时恢复者应做人工呼吸

正确答案：B、D、E。使患者头偏向一侧；解松患者的衣领、裤带等约束的衣物，以利呼吸；注意心脏、呼吸情况，抽搐后呼吸未能及时恢复者应做人工呼吸

解析：本题考查癫痫持续状态的治疗。其同事给予的处理措施中，正确的有：使患者头偏向一侧（B对）；解松患者的衣领、裤带等约束的衣物，以利呼吸（D对）；注意心脏、呼吸情况，抽搐后呼吸未能及时恢复者应做人工呼吸（E对）。发现癫痫发作患者，应立即上前扶住患者，尽量使其慢慢躺下，以免跌伤。同时趁患者齿唇未紧闭之前，把缠有纱布的压舌板垫在上下牙列之间；若患者已完全倒地，可将其缓缓拔正到仰卧位，同时小心地将其头偏向一侧，以防误吸。当患者抽搐停止进入昏睡期后，应迅速抽去牙列垫塞物（侧头），使口中唾液和呕吐物流出，避免窒息。改为侧卧可使患者全身肌肉放松，口水容易流出，舌根也不易后坠阻塞气道；保暖；保持周围安静。抽搐后呼吸未能及时恢复者应做人工呼吸。